小儿腹泻液体疗法，补钾原则错误的是
A. 见尿后及时补钾
B. 轻度脱水可口服补钾
C. 每日补钾3～4mmol/kg
D. 氯化钾静滴浓度3%
E. 补钾一般持续4～6天

正确答案：D。氯化钾静滴浓度3%